男性，65岁。陈旧性广泛前壁心肌梗死7年，活动后胸闷、心悸、气短2年，近1周出现夜间阵发性呼吸困难。体检：端坐呼吸，BP160/90mmHg，P120次/分。P₂亢进，心脏各瓣膜区未闻及杂音。双肺底可闻及细湿啰音，双肺散在哮鸣音。腹平软，肝脾肋下未触及，双下肢无水肿。空腹血糖4.2mmol/L。心电图：V₁～V₆导联ST段压低0.05～0.1mV。血清肌钙蛋白正常。该患者心功能分级为
A. Killip分级Ⅱ级
B. Killip分级Ⅲ级
C. Killip分级Ⅳ级
D. NYHA分级Ⅲ级
E. NYHA分级Ⅳ级

正确答案：E。NYHA分级Ⅳ级

解析：患者老年男性，既往有活动后胸闷心悸气短，近1周出现夜间阵发性呼吸困难，端坐呼吸，P₂亢进，双肺底可闻及细湿啰音，双肺散在哮鸣音，该患者目前最可能的诊断是急性左心衰竭。急性心肌梗死（不是陈旧性心肌梗死）引起的心力衰竭按Killip分级分为四级，其中KillipⅡ级（A错）为双肺湿啰音面积＜50%，Killip分级Ⅲ级（B错）时伴有急性肺水肿，KillipⅣ级（C错）表现为心源性休克。而本例患者并无急性心肌梗死，不能按此分级法，故排除ABC。患者出现夜间阵发性呼吸困难和端坐呼吸，说明休息状态下也存在心衰症状，符合NYHA分级IV级（E对D错）。